心理评估中最常用的一种基本方法是
A. 调查法
B. 会谈法
C. 观察法
D. 作品分析法
E. 心理测验法

正确答案：B。会谈法

解析：心理评估的常用方法主要包括：1)观察法；2)会谈法：也称作“交谈法”、“晤谈法”等。其基本形式是主试者与被评估者面对面的语言交流，也是心理评估中最常用的一种基本方法。3)调查法；4)作品分析法；5)心理测验法。掌握“心理评估概述”知识点。